二便不利应选用的方法是
A. 急则治其标
B. 缓则治其本
C. 标本同治
D. 先扶正后祛邪
E. 先祛邪后扶正

正确答案：A。急则治其标

解析：二便不利为标急，则应先治疗标病。急则治其标，指标病危急，先治其标，标病缓解再治本病，适用于疾病过程中出现某些急重症状，或症状不除，无法进行治疗时，则当权而先治其标，而二便不利，可采用通利二便治标之法，以先缓解危急，再图其本（A对）。缓则治其本，指病势缓和，病情缓慢，先治其本，本病愈而标病自除（B错）；标本同治，指标病与本病并重，应治标与治本兼顾，是在标病与本病俱急，标病与本病俱缓之时采取的一种治则（C错）；先祛邪后扶正即先攻后补。适用于虽然邪盛正虚，但正气尚可耐攻，以邪气盛为主要矛盾，若兼顾扶正反会助邪的病证（E错）；先扶正后祛邪，即先补后攻，适用于正虚邪实，邪虽盛尚不甚急，而机体过于虚弱，正气虚衰不耐攻伐的情况（D错）。